脾胃湿热，常见的症状是
A. 食少腹胀，便溏浮肿
B. 食少腹胀，内脏下垂
C. 食少腹胀，遇怒加剧
D. 食少倦怠，便血崩漏
E. 食少腹胀，舌苔黄腻

正确答案：E。食少腹胀，舌苔黄腻

解析：本题考查的是脾胃湿热的临床表现。脾胃湿热，常见的症状是食少腹胀，舌苔黄腻（E对）。脾病的主要证候有脾气虚证、脾阳虚证、寒湿困脾证及脾胃湿热证。1.脾气虚证的临床表现及辨证要点。由于素体虚弱，劳倦与饮食不节等，内伤脾气，以致脾气虚弱。临床上常见脾虚证候可分三类：（1）脾失健运证：临床表现常见食纳减少，食后作胀，或肢体浮肿，小便不利，或大便溏泻（A错），时息时发，并伴有身倦无力、气短懒言、面色萎黄、舌质淡嫩、苔白、脉缓弱。以运化功能减退和气虚证共见为辨证要点。（2）脾虚下陷证：临床表现常见子宫脱垂，脱肛，胃下垂，慢性腹泻，并见食纳减少，食后作胀，少腹下坠，体倦少气，气短懒言，面色萎黄，舌淡苔白，脉虚。一般以脾气虚和内脏下垂（B错）为辨证要点。（3）脾不统血证：临床表现常见面色苍白或萎黄，饮食减少，倦怠无力，气短，肌衄，便血以及妇女月经过多，或崩漏（D错），舌质淡，脉细弱。一般以在脾气虚的基础上共见出血为辨证要点。2.脾阳虚证的临床表现及辨证要点。脾阳虚证的临床表现，常见在脾失健运症状的基础上，同时出现腹中冷痛，腹满时减，得温则舒，口泛清水，四肢不温，气怯形寒，脉沉迟而舌淡苔白。妇女则见白带清稀，小腹下坠，腰酸沉等症。一般以脾运失健的基础上伴有寒象为辨证要点。3.寒湿困脾证与脾胃湿热证的临床表现及辨证要点。寒湿困脾证的临床表现，常见脘腹胀满，头身困重，食纳减少，泛恶欲吐，口不渴，便溏稀薄，小便不利，妇女带下，舌苔白腻或厚，脉迟缓而濡。一般以脾的运化功能障碍为基础，同时又有寒湿中遏的表现为辨证要点。脾胃湿热证的临床表现，常见面目皮肤发黄，鲜明如橘色，脘腹胀满，不思饮食，厌恶油腻，恶心呕吐，体倦身重，发热，口苦，尿少而黄，舌苔黄腻，脉濡数。一般以脾的运化功能障碍和湿热内阻的症状为辨证要点。症状为食少腹胀，遇怒加剧（C错）的病证，2022年考试指南未明确说明。